以下说法中表述不正确的是
A. 大豆富含蛋白质
B. 大豆富含不饱和脂肪酸
C. 大豆富含磷脂
D. 大豆蛋白质是最好的植物性优质蛋白质
E. 大豆蛋白质是最好的优质蛋白质

正确答案：E。大豆蛋白质是最好的优质蛋白质